固定连接体根据固定桥的制作工艺不同分为
A. 铸造连接体和弯制连接体
B. 焊接连接体和弯制连接体
C. 简单连接体和复杂连接体
D. 整体铸造连接体和焊接连接体
E. 整体弯制连接体和焊接连接体

正确答案：D。整体铸造连接体和焊接连接体

解析：根据固定桥的制作工艺不同分为整体铸造连接体和焊接连接体。掌握“固定桥的设计”知识点。